男，58岁。进行性吞咽困难2月余，上消化道X线钡餐造影见食管下段黏膜紊乱，部分管壁僵硬。为明确诊断，首选的检查是
A. 食管拉网
B. 胸部增强CT
C. 食管超声
D. PET-CT
E. 食管镜

正确答案：E。食管镜

解析：中老年男性患者，有进行性吞咽困难（食管癌的典型症状），上消化道钡剂造影见食管下段黏膜紊乱，部分管壁僵硬（食管癌中晚期影像学表现），疑诊食管癌。为明确诊断，首选的检查是食管镜（E对）。食管镜可直接观察病灶的形态，并可在直视下做活检，以确定诊断。食管拉网（A错）对细胞学阳性，而X线和食道镜检查不能肯定的病例进行定位。胸部增强CT（B错）可用于支气管扩张或胸部纵膈肿瘤的辅助诊断，不用于确诊食管癌。PET-CT（D错）全称为正电子发射断层显像，用于多种疾病的早期发现和诊断。